霉变甘蔗中毒常发生于
A. 初春季节
B. 初夏季节
C. 夏秋季节
D. 初秋季节
E. 初冬季节

正确答案：A。初春季节